下列疾病的病理表现中能够观察到含有嗜伊红颗粒的大嗜酸性粒细胞的是
A. 多形性腺瘤
B. 沃辛瘤
C. 恶性多形性腺瘤
D. 腺泡细胞癌
E. 粘液表皮样癌

正确答案：B。沃辛瘤

解析：沃辛瘤又称腺淋巴瘤，瘤体内常含有大小不等的囊腔样结构，腔内侧细胞为胞质内含有嗜伊红颗粒的大嗜酸性粒细胞。掌握“沃辛瘤及嗜酸性腺瘤”知识点。